治疗急性肾小球肾炎风热犯肺，水邪内停证，应首选
A. 麻黄汤合五苓散
B. 麻黄汤合五皮饮
C. 麻黄连翘赤小豆汤
D. 越婢加术汤
E. 五皮饮合五苓散

正确答案：D。越婢加术汤

解析：急性肾小球肾炎风热犯肺，水邪内停证，治宜散风清热，宣肺行水，首选疏风泄热，发汗利水的越婢加术汤（D对）。麻黄汤合五苓散疏风散寒，宣肺行水，是急性肾小球肾炎风寒束肺，风水相搏证的代表方（A错）。五皮饮利水消肿，理气健脾，主治水停气滞之皮水证（B错）。麻黄连翘赤豆小汤主治湿热蕴郁于内，外阻经络肌肤之病候，配合五味消毒饮可治疗急性肾小球肾炎疮毒内归，湿热蕴结证（C错）。五皮饮利水消肿，理气健脾，主治水停气滞之皮水证；五苓散利水渗湿，温阳化气（E错）。